伤食多见
A. 食欲减退
B. 消谷善饥
C. 恶闻食臭
D. 饥不欲食
E. 嗜食异物

正确答案：C。恶闻食臭

解析：本题考查的是食欲与食量异常变化的临床意义。伤食多见恶闻食臭（C对）。食欲与食量异常变化的临床意义：食欲减退（A错）或不欲食，胃纳呆滞，多是脾胃功能失常的表现。若食少见于久病，兼有面色萎黄、形瘦、倦怠等症者，属脾胃虚弱；而食少伴有胸闷、腹胀、肢体困重、舌苔厚腻者，则多是脾湿不运。厌恶食物或恶闻食臭，即为厌食，又称“恶食”，多见于伤食。妇女怀孕，亦可有厌食的反应，多因妊娠后冲脉之气上逆、胃失和降所致。厌油腻厚味，多见于肝胆脾胃湿热的病证。有饥饿感，但不想吃或进食不多者，称为饥不欲食（D错），多因胃阴不足、虚火上扰所致。食欲过于旺盛、食后不久即感饥饿者，为消谷善饥（B错），往往身体反见消瘦，这是胃火炽盛、腐熟太过所致，如《灵枢·师传》所云：“胃中热则消谷，令人悬心善饥。”易饥多食，但大便溏泻、倦怠乏力，属胃强脾弱。嗜食生米、泥土等异物（E错），尤多见于小儿，往往是虫积的征象。妇女妊娠偏嗜某种食物，一般不属病态。